关于抗原，下列哪项组合是错误的
A. 半抗原——青霉素
B. 自身抗原——HLA抗原
C. 异种抗原——病原微生物
D. 细胞质抗原——线粒体抗原
E. 异嗜性抗原——Forssman抗原

正确答案：B。自身抗原——HLA抗原